癫痫的复杂部分性发作的病损在
A. 中央前回
B. 锥体外系统
C. 小脑
D. 枕叶
E. 颞叶

正确答案：E。颞叶

解析：癫痫复杂部分性发作病灶多在颞叶（E对），因而也叫颞叶癫痫。中央前回（A错）及附近是癫痫部分运动性发作病灶。锥体外系统（B错）病损会导致以随意运动迟缓、不自主运动、肌张力异常、姿势步态障碍等运动症状为主要表现的神经系统疾病，如帕金森核小舞蹈病。枕叶（D错）癫痫主要表现为伴有视觉症状的单纯部分性发作（P305）。小脑（C错）病损主要表现为共济失调（P19）。